上皮性卵巢癌的治疗首选
A. 顺铂+博莱霉素+依托泊苷
B. 顺铂+拓扑替康
C. 卡铂+紫杉醇
D. 卡铂+吉西他滨
E. 顺铂+阿霉素

正确答案：C。卡铂+紫杉醇

解析：上皮性卵巢癌初次治疗原则是手术为主，辅以化疗、放疗等综合治疗。其对化疗较敏感，即使已有广泛转移也能取得一定疗效。除经过全面分期手术的ⅠA期和ⅠB期且为G1（高分化）的患者不需化疗外，其他患者均需化疗。多采用以铂类为基础的联合化疗方案，常用化疗方案有TC、TP和PC。TC方案包括紫杉醇（T）＋卡铂（C）（C对）。TP方案包括紫杉醇（T）＋顺铂（P）；PC方案包括顺铂（P）＋环磷酰胺（C）。